患者，男，66岁，BMI24kg/m²，高血压病史15年，冠心病史3年，目前规律服用阿司匹林、贝那普利、氨氯地平、美托洛尔、阿托伐他汀、螺内酯、呋塞米、单硝酸异山梨酯治疗。患者饮酒饱餐后出现胸闷，心前区疼痛，自服1片硝酸甘油不能缓解，来急诊科就诊。查体：血压163/83mmHg，心率80次1分。临床诊断为：（1）心绞痛急性发作；（2）心功能不全、心功能Ⅲ级；（3）高血压病3级；（4）高脂血症。该患者自述服用硝酸甘油无效，可能的原因不包括
A. 贝那普利、阿托伐他汀等拮抗硝酸甘油的疗效
B. 硝酸甘油片被吞服，而不是舌下含服
C. 硝酸甘油片已经过期
D. 硝酸甘油片单次剂量不足，次数不足
E. 硝酸甘油片未密闭遮光保存，药品变质失效

正确答案：A。贝那普利、阿托伐他汀等拮抗硝酸甘油的疗效

解析：本题考查药物的相互作用。贝那普利、阿托伐他汀不会拮抗硝酸甘油的疗效（A错，为本题正确答案）。ACEI类、他汀类、硝酸酯类这几种药物之间不存在药物相互作用。硝酸甘油口服后经过肝脏的首过效应灭活失效，生物利用低（B对）。硝酸甘油片已经过期（C对）、硝酸甘油片单次剂量不足，次数不足（D对）、硝酸甘油片未密闭遮光保存，药品变质失效（E对）等都会对疗效产生影响，不能发挥疗效。